女性，28岁，已婚，生育1子。两地分居，丈夫最近将回家探亲，拟服用探亲片（甲地孕酮），正确的服药方法是
A. 月经来潮第5天服1片，12天后再服1片
B. 月经周期第5天开始，每晚1片，连服22天
C. 性交前8小时服1片，当晚再服1片，以后每晚1片，至探亲结束次晨加服1片
D. 性交后即服1片，次晨加服1片
E. 探亲当日中午含服1片，以后每次性交后服1片

正确答案：C。性交前8小时服1片，当晚再服1片，以后每晚1片，至探亲结束次晨加服1片

解析：探亲避孕药除双炔失碳酯外，均为孕激素类制剂或雌孕激素复合剂。适用于短期探亲夫妇。探亲避孕药（甲地孕酮）服用方法：性交前8小时服1片，当晚再服1片，以后每晚1片，至探亲结束次晨加服1片（C对）。